符合结核性脑膜炎的脑脊液变化的是
A. 白细胞总数5×10⁶/L，淋巴细胞为主，蛋白质0.3g/L，葡萄糖3.5mmol/L，氯化物120mmol/L
B. 白细胞总数10×10⁶/L，淋巴细胞为主，蛋白质0.3g/L，葡萄糖3.5mmol/L，氯化物125mmol/L
C. 白细胞总数20×10⁶/L，中性粒细胞为主，蛋白质0.4g/L，葡萄糖2.5mmol/L，氯化物120mmol/L
D. 白细胞总数200×10⁶/L，淋巴细胞为主，蛋白质0.8g/L，葡萄糖2.0mmol/L，氯化物100mmol/L
E. 白细胞总数2000×10⁶/L，中性粒细胞为主，蛋白质1g/L，葡萄糖1.5mmol/L，氯化物106mmol/L

正确答案：D。白细胞总数200×10⁶/L，淋巴细胞为主，蛋白质0.8g/L，葡萄糖2.0mmol/L，氯化物100mmol/L

解析：正常人脑脊液白细胞数为（0～5）×10⁶/L，主要为单核细胞。蛋白质含量为0.15～0.45g/L，糖含量为2.5～4.4mmol/L，氯化物为120～130mmol/L。结核性脑膜炎是由结核杆菌引起的脑膜和脊膜的非化脓性炎症性疾病，其脑脊液检查淋巴细胞数显著增高（CE错），蛋白质增高，通常为1～2g/L（AB错），糖及氯化物下降，故白细胞总数200×10⁶/L，淋巴细胞为主，蛋白质0.8g/L，葡萄糖2.0mmol/L，氯化物100mmol/L（D对）符合结核性脑膜炎的脑脊液变化。